可摘局部义齿塑料基托的厚度一般为
A. 0.5mm
B. 1mm
C. 1.5mm
D. 2mm
E. 2.5mm

正确答案：D。2mm

解析：塑料基托一般厚约2mm，进入前庭沟和口底的基托边缘略厚，并呈圆钝状。掌握“局部义齿人工牙及基托”知识点。